水蛭的内服用量是
A. 1～3g
B. 3～6g
C. 3～9g
D. 5～9g
E. 3～5g

正确答案：A。1～3g

解析：本题考查的是现行《中国药典》收载毒性药材和饮片的用法用量。水蛭的内服用量是1～3g（A对）。水蛭：有小毒，用量1～3g。孕妇禁用。3～6g（B错）为全蝎的用量。全蝎：有毒，用量3～6g。孕妇禁用。3～9g（C错）为蕲蛇的用量。蕲蛇：有毒，用量3～9g。研末吞服，每次1～1.5g，每日2～3次。5～9g（D错）为常山的用量。常山：有毒。用量5～9g。孕妇慎用。有催吐副作用，量不宜过大。3～5g（E错）为蜈蚣的用量。蜈蚣：有毒。用量3～5g。孕妇禁用。